可用5%NaHC0₃水溶液萃取的是
A. 5， 4-二甲基黄酮
B. 5，3-二甲基黄酮
C. 5，4-二甲氧基黄酮
D. 7，4-二羟基黄酮
E. 7，4-二甲氧基黄酮

正确答案：D。7，4-二羟基黄酮

解析：本题考查黄酮类化合物的提取方法。可用5%NaHC0₃水溶液萃取的是7，4-二羟基黄酮（D对）。黄酮类化合物中有酚羟基的取代而显酸性，由于羟基的数目和位置不同，酸性强弱也不同，利用这一特性，将植物提取的总黄酮溶于有机溶剂中，依次按弱碱至强碱，从稀碱至浓碱水溶液的顺序进行萃取，就可以将黄酮按较强酸性至较弱酸性的顺序分别萃取出来。如将混合物溶于有机溶剂（如乙醚），依次用5%碳酸氢钠（萃取7，4’-二羟基黄酮）、5%的碳酸钠（萃取7-羟基黄酮或4’，2-羟基黄酮）、0.2%氢氧化钠（萃取一般酚羟基黄酮）、4%氢氧化钠（萃取5-羟基黄酮）萃取而使其分离。